葡萄球菌由于具有以下特点，而使得其一旦在食物中产生，就很难用一般的烹调方法将其去除
A. 可以在7.5%的盐水中大量生长
B. 低温下可以维持数月
C. 耐热性很强，加热不易破坏
D. 不受胰蛋白酶的破坏
E. 以上都是

正确答案：E。以上都是